下列关于口腔各部对痛觉敏感度的叙述中，正确的是
A. 对疼痛的敏感程度与痛觉感受器分布的密度呈正相关
B. 游离神经末梢分布较密集者，对疼痛敏感的程度较高
C. 牙髓对疼痛敏感的程度较高
D. 游离神经末梢分布较少对疼痛敏感的程度较低
E. 以上均正确

正确答案：E。以上均正确

解析：口腔各部对痛觉的敏感度：对疼痛的敏感程度与痛觉感受器（游离神经末梢）分布的，密度呈正相关，游离神经末梢分布较密集者，对疼痛敏感的程度较高，如牙髓；游离神经末梢分布较少者，对疼痛敏感的程度较低。掌握“口腔感觉”知识点。